铁笛丸的功能是
A. 清热解毒，消肿止痛
B. 清音利咽，消肿止痛
C. 润肺利咽，生津止渴
D. 疏风清热，消肿止痛，清利咽喉
E. 疏风清热，化痰散结，利咽开音

正确答案：C。润肺利咽，生津止渴

解析：本题考查的是铁笛丸的功能。铁笛丸的功能是润肺利咽，生津止渴（C对）。铁笛丸【功能】润肺利咽，生津止渴。冰硼散【功能】清热解毒，消肿止痛（A错）。西瓜霜润喉片【功能】清音利咽，消肿止痛（B错）。复方草珊瑚含片【功能】疏风清热，消肿止痛，清利咽喉（D错）。黄氏响声丸【功能】疏风清热，化痰散结，利咽开音（E错）。